急性尿潴留病因中，属于非机械性梗阻的是
A. 尿道结石
B. 外伤性高位截瘫
C. 尿道断裂
D. 尿道肿瘤
E. 前列腺增生

正确答案：B。外伤性高位截瘫

解析：尿潴留的病因可分为机械性梗阻和非机械性梗阻，其中机械性梗阻最多见。由非机械性梗阻而引起的急性尿潴留的原因有脊髓或马尾损伤所致的外伤性高位截瘫（B对）、糖尿病、直肠肛管手术损伤副交感神经分支、腰麻术后等，此外还有阿托品、山莨菪碱等松弛平滑肌的药物等。机械性因素包括前列腺增生（E错）、前列腺肿瘤、膀胱颈挛缩、各种原因引起的尿道狭窄、断裂（C错）、肿瘤（D错）和尿道结石（A错）等。